以下所述的原因在片剂制备中可能产生混合不均匀或可溶性成分迁移的是
A. 裂片
B. 黏冲
C. 片重差异超限
D. 均匀度不符合要求
E. 崩解超限或溶出速度降低

正确答案：D。均匀度不符合要求

解析：本题考查片剂制备中的常见问题及原因。混合不均匀或可溶性成分迁移可能使片剂含量不均匀，均匀度不符合要求（D对）；产生裂片（A错）的原因有物料中细粉太多及物料的塑性差，结合力弱等；黏冲（B错）的主要原因是颗粒不够干燥、润滑剂选用不当或用量不足、冲头表面锈蚀等；片重差异超限（C错）原因是物料的流动性差、物料中细粉太多或颗粒大小相差悬殊等；崩解迟缓或崩解超限（E错）原因是片剂的压力过大、增塑性物料或黏合剂使片剂的结合力过强及崩解剂性能较差。